应用地西泮可治疗
A. 原因不明头痛
B. 三叉神经痛
C. 紧张和焦虑性头痛
D. 反复性偏头痛
E. 丙酮与乳酸堆积的头痛

正确答案：C。紧张和焦虑性头痛

解析：本题考查镇静催眠药地西泮。应用地西泮可治疗紧张和焦虑性头痛（C对）；原因不明的头痛（A错）不能确定疼痛的来源，无法正确用药；三叉神经痛（B错）可用卡马西平治疗；反复性偏头痛（D错）可用麦角胺咖啡因治疗；丙酮与乳酸堆积的头痛（E错）可用维生素B₁治疗。